女，59岁。右颈部淋巴结肿大3个月，蚕豆大小，其可能性最小的病变是
A. 转移癌
B. 淋巴结反应性增生
C. 恶性淋巴瘤
D. 淋巴结结核
E. 转移性肉瘤

正确答案：E。转移性肉瘤

解析：肉瘤细胞多弥漫分布，实质与间质分界不清，间质内血管丰富而纤维结缔组织少，因此肉瘤主要经血道转移，较少经淋巴转移，故该淋巴结为转移性肉瘤（E对）的可能性最小。肺癌可经支气管、肺门淋巴结转移至锁骨上、颈部深淋巴结形成转移癌（A错），消化道肿瘤亦可转移至颈部魏尔肖淋巴结形成转移癌。所有的淋巴结均可因炎症出现反应性增生（B错）。颈部淋巴结为恶性淋巴瘤（C错）、淋巴结结核（D错）的好发部位。